用于氯丙嗪中毒时的药物是
A. 多巴胺
B. 肾上腺素
C. 间羟胺
D. 去甲肾上腺素
E. 异丙肾上腺素

正确答案：D。去甲肾上腺素

解析：氯丙嗪能阻断α受体可出现鼻塞、体位性低血压、心悸等，药后应卧床1～2小时，起立时应缓慢，避免出现体位性低血压。去甲肾上腺素主要用于早期神经源性休克以及嗜铬细胞瘤切除后或药物中毒时的低血压（D对）。